一淋巴结作病理切片检查，淋巴结内见成团的异型细胞，并有病理性核分裂相和角化珠形成，应诊断为
A. 淋巴结结核
B. 淋巴结慢性炎症
C. 淋巴结转移性腺癌
D. 恶性淋巴瘤
E. 淋巴结转移性鳞癌

正确答案：E。淋巴结转移性鳞癌

解析：本例的淋巴结病理切片中可见异型细胞及病理性核分裂相，此为恶性肿瘤的特点，又因角化珠形成是高分化鳞癌的特征性病变，故应诊断为淋巴结转移性鳞癌（E对）。淋巴结结核（P358）（A错）和淋巴结慢性炎症（P219）（B错）均为良性病变，前者的病变特点为结核结节形成和干酪样坏死；后者的病变特点为淋巴滤泡增生、副皮质区淋巴增生和窦组织细胞增生等。淋巴结转移性腺癌（C错）的病变特点为癌细胞形成不规则的腺样结构。恶性淋巴瘤（P221）（D错）是原发于淋巴结和结外淋巴组织的恶性肿瘤，可分为霍奇金淋巴瘤和非霍奇金淋巴瘤，前者的病变特点为诊断性R-S细胞及其变异型细胞出现；后者的病变特点为正常淋巴结结构消失，为不同分化程度的淋巴细胞所代替。